修复体修复患牙，为了防止继发龋的发生，要做到
A. 修复体要正确地恢复患牙的解剖形态
B. 修复体要能恢复患牙的功能
C. 修复体尽可能厚些，隔绝细菌侵入
D. 修复体边缘线要位于自洁区
E. 以上均是

正确答案：D。修复体边缘线要位于自洁区

解析：本题考查为了防止继发龋的发生的牙体预备。由于粘固剂和粘接剂可被唾液所溶解，故患者修复体与牙的边缘结合部位是继发龋的好发部位。牙齿的四个轴面突起的位置被称为自洁区。牙齿的自洁区在咀嚼食物时随着舌头的搅拌、颊侧内部的摩擦、食物的摩擦等一系列外力作用下可达到的光滑程度，稍有硬度的食物颗粒较粗，随着食用可以进一步更好的摩擦牙齿表面，使其更加光洁，可减少自发龋，故修复体边缘线要位于自洁区（D对）。恢复患牙的解剖形态（A错）、恢复牙的生理功能（B错），有利于保护牙和牙周组织的健康，而与继发龋的发生无关。修复体变厚（C错）对修复体边缘位置的设计无影响，故与继发龋的发生无关系。